被肠道病原体污染的水是
A. 传染来源
B. 传播因素
C. 传播途径
D. 传播方式
E. 传染源

正确答案：B。传播因素

解析：本题考查传播因素。被肠道病原体污染的水是传播因素（B对ACDE错）。此外，传播因素还包括空气、食物、土壤等无生命物质。